环境质量评价方法国内外目前常用的有数理统计法、环境质量指数法、模糊综合评价法、灰色聚类法、密切值法，其中最为经典、最常用的是
A. 模糊综合评价法、密切值法
B. 数理统计法、灰色聚类法
C. 数理统计法、环境质量指数法
D. 灰色聚类法、密切值法
E. 环境质量指数法、模糊综合评价法

正确答案：C。数理统计法、环境质量指数法

解析：本题考查最常用、最经典的环境质量评价方法。国内外目前常用的评价方法有数理统计法、环境质量指数法、模糊综合评判法、灰色聚类法、密切值法等，其中最常用、最经典的是数理统计法和环境质量指数法（C对ABDE错）。